流感主要经
A. 体液传播
B. 土壤传播
C. 飞沫传播
D. 水食物苍蝇传播
E. 蚊虫传播

正确答案：C。飞沫传播

解析：流感主要经飞沫传播，也可通过接触被污染的手、日常用具等间接传播（C对）。原体存在于携带者或患者的血液或体液中，通过应用血制品、分娩或性交等传播，如疟疾、乙型病毒性肝炎、丙型病毒性肝炎和艾滋病等（A错）。易感者与被病原体污染的水或土壤接触时获得感染，如钩端螺旋体病、血吸虫病和钩虫病等（B错）。病原体污染食物、水源或食具，易感者于进食时获得感染，如伤寒、细菌性痢疾和霍乱等（D错）。病原体感染的吸血节肢动物，如按蚊、人虱、鼠蚤、白蛉、硬蜱和恙螨等，于叮咬时把病原体传给易感者，可分别引起疟疾、流行性斑疹伤寒、地方性斑疹伤寒、黑热病、莱姆病和恙虫病等（E错）。